去年弗兰明汉姆研究中死于心脏疾病的女性的数量/弗兰明汉姆研究中心最初的女性数量
A. 发病率
B. 患病率
C. 死亡率
D. 病死率
E. 罹患率

正确答案：C。死亡率

解析：本题考查死亡率。死亡率（C对ABDE错）表示在一定期间内，某人群中总死亡人数在该人群中所占的比例，是测量人群死亡危险最常用的指标。其分子为死亡人数，分母为该人群同期平均人口数。